乙脑的主要死因是
A. 呼吸衰竭
B. 脑水肿
C. 高热抽搐
D. 意识障碍
E. 循环衰竭

正确答案：A。呼吸衰竭

解析：乙脑的主要死因是呼吸衰竭（A对），因位于延髓的呼吸中枢严重受损易导致患者突发呼吸骤停而死亡。脑水肿（B错）、高热抽搐（C错）、意识障碍（D错）及循环衰竭（E错）均可见于流行性乙型脑炎极期，可致死，但其致死率不如呼吸衰竭高。